下列哪种激素不增加机体产热
A. 甲状腺激素
B. 孕激素
C. 雌激素
D. 肾上腺素
E. 去甲肾上腺素

正确答案：C。雌激素